链激酶、链道酶、透明质酸酶产自下列哪种细菌
A. 沙门菌
B. 肺炎链球菌
C. 淋病奈瑟菌
D. A群链球菌
E. 金黄色葡萄球菌

正确答案：D。A群链球菌

解析：A群链球菌的胞壁成分有较强的侵袭力，还可以产生多种胞外毒素和胞外酶也是致病物质。其中链激酶、链道酶和透明质酸酶为侵袭性酶，也是扩散因子，与致病性密切相关。掌握“链球菌属”知识点。